5岁男孩，低热，干咳，皮肤结节性红斑，疱疹性结膜炎，多发性一过性关节炎及颈淋巴结肿大常见于
A. 风湿热
B. 传染性单核细胞增多症
C. 类风湿性关节炎
D. 原发性肺结核
E. 川畸病

正确答案：D。原发性肺结核

解析：原发性肺结核多见于儿童，临床症状有起病缓慢，常以全身结核中毒症状为主，2-3周后转为持续低热；咳嗽；高度肿大的淋巴结可出现压迫和刺激症状，常见为干咳和刺激性咳嗽；少数患者可伴有结核变态反应引起的过敏表现如结节性红斑、疱疹性结膜炎等（D对）。川崎病（P164）表现为持续高热，多形红斑样皮疹，无疱疹和结痂（E错）。风湿热（P154）5个主要表现为游走性多发性关节炎、心脏炎、皮下结节、环形红斑、舞蹈病，与题干不符（A错）。传染性单核细胞增多症患者多有不同程度的发热，一般波动于39度左右，偶有40度；淋巴结肿大是本病特征之一，故又称“腺热病”。全身浅表淋巴结均可累及，颈部淋巴结肿大最常见，淋巴结一般分散无粘连，无压痛，无化脓；多数患儿出现咽痛，扁桃体肿大，陷窝可见白色渗出，偶可形成假膜；部分患者会出现形态不一的皮疹，如丘疹、斑丘疹或类似麻疹及猩红热皮疹，很少出现干咳及一过性关节炎（B错）。类风湿性关节炎的诊断：（1）晨僵至少一小时（≥6周）；（2）3个或3个以上关节肿胀（≥6周）；（3）腕、掌、指或近端指间关节肿胀（≥6周）；（4）对称性关节肿胀（≥6周）；（5）手部有典型的类风湿性关节炎的放射学改变；（6）皮下有类风湿结节；（7）类风湿因子数阳性（滴定度＞1：32）。具备4项以上者，可诊断为典型类风湿性关节炎，与题干不符（C错）。